脱位牙再植后最好的愈合方式是
A. 骨性粘连
B. 牙周膜愈合
C. 牙根面炎症性外吸收
D. 牙根炎症性内吸收
E. 牙脱落

正确答案：B。牙周膜愈合

解析：本题考查牙再植后的愈合方式。牙再植后的愈合方式有：牙周膜愈合、骨性粘连、炎症性吸收。牙周膜愈合即牙与牙槽之间形成正常牙周膜愈合，是再植牙最理想的愈合方式（B对）。骨性粘连是牙根的牙骨质和牙本质被吸收由骨质代替，发生的置换性吸收，这种置换性吸收可呈进行性发展，易导致牙齿脱落（A错）。炎症性吸收可导致牙髓坏死，是失败的愈合方式（CD错）。牙脱落不属于再植牙的愈合方式（E错）。